女，35岁。丈夫因车祸去世，令其痛不欲生，遂到心理咨询门诊寻求帮助。该女生在诉说其目前的心境时痛哭流涕。对此，心理咨询师在初始阶段一般不应采取的措施是
A. 对质其懦弱
B. 帮助其领悟
C. 增强其自控
D. 指导其放松
E. 接受其宣泄

正确答案：A。对质其懦弱

解析：心理治疗实际操作的基本过程包括初期、中期和后期阶段。每个阶段各有不同的任务。初期的主要任务是建立治疗关系、收集信息、评估和确认问题及制定治疗方案。在心理咨询初始阶段应首先建立好咨询关系，不可过早对质该患者懦弱（A错，为本题正确答案）。初期要帮助患者认识到自己是治疗过程的积极参与者，有责任提供信息并完成治疗期间的作业与练习，以及共同来思考合适的治疗目标。在初期的会谈中，治疗者通过面谈、观察、问卷、心理测验、生理心理评估、医学检查收集临床资料用于了解患者的主要心理问题，并进行诊断、制订治疗方案并签署治疗协议。中期主要是帮助患者改变不良认知、情绪和行为，建立新的适应性认知、情绪和行为模式，达到预期治疗目标。后期主要是处理结束治疗所产生的问题及帮助迁移和巩固治疗所获得的成果。帮助其领悟（B对）、增强其自控（C对）、指导其放松（D对）、接受其宣泄（E对）均是初始阶段可以采取的措施。